薤白的功效是
A. 疏肝解郁，行气导滞
B. 通阳散结，行气导滞
C. 通阳散结，解毒消肿
D. 散寒通阳，解毒散结
E. 散寒通阳,行气导滞

正确答案：B。通阳散结，行气导滞

解析：薤白辛行苦降、有行气导滞、消肿止痛之功；本品辛散苦降、温通滑利，善散阴寒之凝滞，通胸阳之闭结，为治胸痹的要药。故薤白的功效是通阳散结，行气导滞（B对）。应用于胸痹心痛，脘腹痞满胀痛，泻痢里急后重的治疗。